釉质龋最早出现的病理变化是
A. 透明
B. 混浊
C. 色素沉着
D. 崩解
E. 再矿化

正确答案：A。透明

解析：透明层：位于病损的最前沿，和正常釉质相连，是龋损最早发生的组织学改变。掌握“牙釉质龋”知识点。